在队列研究中，对关联强度进行统计学检验的无效假设是
A. RR＝0
B. RR＝1
C. RR＞1
D. RR＜1
E. RR＞0

正确答案：B。RR＝1

解析：本题考查疾病关联强度指标。RR是表示关联强度的重要指标，RR说明暴露者发生相应疾病的危险是非暴露者的多少倍，具有病因学的意义。当RR＝1（B对ACDE错）时，说明暴露组和非暴露组无差异，为无效假设。